与津液输布和排泄相关的脏腑功能有
A. 肺的宣发
B. 肺的肃降
C. 肾的气化
D. 脾的运化
E. 脾的“散精”

正确答案：A、B、C、D、E。肺的宣发；肺的肃降；肾的气化；脾的运化；脾的“散精”

解析：本题考查的是津液的输布、排泄障碍。与津液输布和排泄相关的脏腑功能有肺的宣发（A对）、肺的肃降（B对）、肾的气化（C对）、脾的运化（D对）与脾的“散精”（E对）。津液的输布、排泄障碍：津液的输布障碍，是指津液得不到正常的输布，导致津液在体内环流迟缓，或在体内某一局部发生滞留，因而津液不化，水湿内生，酿痰成饮。津液的排泄障碍主要是指津液转化为汗液和尿液的功能减退，而致水液潴留，上下溢于肌肤而为水肿。导致津液输布排泄障碍的原因很多，主要涉及肺的宣发和肃降、脾的运化和散精、肝的疏泄条达、肾的蒸腾气化和三焦的水道是否通利。应当指出，津液的输布障碍和排泄障碍，二者虽然有别，但亦常相互影响和互为因果，其结果导致内生水湿，酿痰成饮，引起多种病变。